对侧柏叶的说法正确的是
A. 外表面灰棕色或黄棕色
B. 有香气
C. 两者均是
D. 两者均不是

正确答案：B。有香气

解析：本题考查的是侧柏叶药材的性状鉴别。对侧柏叶的说法正确的是有香气（B对）。侧柏叶：【性状鉴别】药材多分枝，小枝扁平。叶细小鳞片状，交互对生，贴伏于枝上，深绿色或黄绿色（A错）。质脆，易折断。气清香，味苦涩、微辛。